属于必需氨基酸的是
A. 丙氨酸
B. 丝氨酸
C. 天冬氨酸
D. 甲硫氨酸
E. 谷氨酸

正确答案：D。甲硫氨酸

解析：必需氨基酸包括缬氨酸、异亮氨酸、亮氨酸、苯丙氨酸、蛋氨酸（甲硫氨酸）（D对）、色氨酸、苏氨酸、赖氨酸（记忆技巧：写一两本淡色书来），其他的氨基酸均为非必需氨基酸（ABCE错）。酸性氨基酸包括谷氨酸、天冬氨酸（记忆技巧：三伏天）。非极性脂肪族氨基酸包括脯氨酸、缬氨酸、异亮氨酸、亮氨酸、丙氨酸、甘氨酸（记忆技巧：谱写一两个丙肝患者）。碱性氨基酸包括赖氨酸、精氨酸、组氨酸（记忆技巧：拣来精读）。极性中性氨基酸包括谷氨酰胺、天冬酰胺、半胱氨酸、甲硫氨酸、苏氨酸、丝氨酸（记忆技巧：古天乐半光身子，假陪苏三）。芳香族氨基酸包括酪氨酸、苯丙氨酸、色氨酸（记忆技巧：芳香老本色）。